化妆品中容易引起过敏反应的成分是
A. 无机盐类
B. 赋形剂
C. 色素
D. 动物提取物
E. 微生物

正确答案：D。动物提取物

解析：本题考查化妆品中容易引起过敏反应的成分。有的化妆品中添加有动物提取物（D对ABCE错），如用于护肤品的牛羊的胎盘提取液；用于护发素、夜霜、剃须膏的牛血清蛋白；用于抗皱霜的牛脑组织提取的表皮细胞生长因子、羊胎素等，这些成分如从感染了疯牛病病原体的动物体中提取，就有可能含有致病的朊病毒，导致克雅病的发生。